毒蕈中毒在临床上可分为6期的是哪一型
A. 神经精神型
B. 胃肠炎型
C. 溶血型
D. 肝肾损害型
E. 呼吸道感染型

正确答案：D。肝肾损害型